血浆胶体渗透压主要来自
A. 纤维蛋白原
B. α₁-球蛋白
C. α₂-球蛋白
D. 清(白）蛋白
E. γ-球蛋白

正确答案：D。清(白）蛋白

解析：溶液渗透压高低取决于溶液中溶质颗粒（分子或离子）数目的多少，而与溶质的种类和颗粒大小无关。由血浆蛋白质所形成的渗透压为血浆胶体渗透压，血浆蛋白包括白蛋白、球蛋白和纤维蛋白原（P55）三类，在血浆蛋白中，白蛋白占绝大多数，且白蛋白分子量小，故血浆胶体渗透压的主要物质是白蛋白（D对A错）。球蛋白可以用电泳法（P55）区分为α1-球蛋白（B错）、α2-球蛋白（C错）、β-球蛋白和γ-球蛋白（E错）等。